古人提出“春夏养阳，秋冬养阴”旨在强调
A. 保养阴气的重要性
B. 调养四时阴阳的重要性
C. 春夏重在保养阳气
D. 秋冬重在保养阴气
E. 保养阳气的重要性

正确答案：B。调养四时阴阳的重要性

解析：“春夏养阳，秋冬养阴”的含义是由于四时阴阳是万物之根本，万物皆生于春，长于夏，收于秋，藏于冬，人亦应之。所以，春夏当顺生长之气，秋冬当顺其收藏之气。具体言之，春养少阳，以助生发之气；夏养太阳，以助盛长之气；秋养少阴，以助收敛之气；冬养太阴，以助闭藏之气，使人体阴阳与自然界四时阴阳消长变化保持协调一致（B对）。